男，70岁。吞咽困难半个月。查体无明显阳性体征。上消化道钡餐造影示食管中段黏膜紊乱，管壁僵硬，管腔狭窄。该患者最可能的初步诊断是
A. 食管炎
B. 食管憩室
C. 贲门失弛缓症
D. 食管癌
E. 食管平滑肌瘤

正确答案：D。食管癌

解析：老年男性患者，吞咽困难，钡餐造影示食管中段黏膜紊乱，管壁僵硬，管腔狭窄，结合患者临床表现和相关检查，该患者最可能的初步诊断是食管癌（D对）。食管炎（A错）主要表现为“烧心”、吞咽疼痛，钡剂造影一般无阳性表现。贲门失弛缓症（C错）主要表现为间断性咽下困难，钡剂造影典型表现为食管下端及贲门部呈鸟嘴状。食管憩室（B错）多无症状，若憩室内有食物残留，可引起颈部压迫感。食管平滑肌瘤（E错）为良性肿瘤，可有进食梗咽感，钡剂造影典型表现为“半月状”压迹。